患者，男，35岁。心悸不宁，头晕目眩，手足心热，耳鸣腰酸，舌红少苔，脉细数。其证候是
A. 心血不足
B. 心虚胆怯
C. 心阴亏虚
D. 阴虚火旺
E. 心火内盛

正确答案：D。阴虚火旺

解析：本病例以心悸不宁为主症，故诊断心悸；肾阴不足，水不济火，不能上济于心，以致心火内动，扰动心神，故心悸不宁；阳扰于上，故头晕目眩；阴亏于下，故耳鸣腰酸；手足心热，舌红少苔，脉细数，均为阴虚火旺之征，故其证候为阴虚火旺证（D对）。心悸之心血不足证的临床表现为：心悸气短，头晕目眩，失眠多梦，面色无华，神疲乏力，纳呆食少，腹胀便溏，舌淡红，脉细弱（A错）。心悸之心虚胆怯证的临床表现为：心悸不宁，善惊易恐，坐卧不安，少寐多梦而易惊醒，食少纳呆，恶闻声响，苔薄白，脉细略数或细弦(B错)。本病例以肾阴亏虚为主（C错）。心火内盛为实火，本病例为虚火（E错）。